规格为25mg的片剂，处方上用法为25mgtid，药师粘贴用法标签时正确的写法是
A. 每日3次，每次0.5片
B. 每日3次，每次1片
C. 每日2次，每次1片
D. 每日2次，每次2片
E. 每日1次，每次1片

正确答案：B。每日3次，每次1片

解析：本题考查处方中常见的外文缩写及其含义。tid为每日3次的缩写词，25mg tid表示每日3次，每次25mg。该片剂规格为25mg/片，因此正确用法为每日3次，每次1片（B对）。每日2次（CD错）的缩写为bid。每日1次（E错）的缩写为qd。